蜗窗位于鼓室的
A. 前壁
B. 后壁
C. 外侧壁
D. 内侧壁
E. 下壁

正确答案：D。内侧壁

解析：内侧壁又称迷路壁，其中部有圆形的隆起，称岬，岬的后下方有一圆形小孔，称蜗窗或圆窗（D对）。